患者面色苍白，时而泛红如妆，其病证多为
A. 阴虚火旺
B. 肝胆湿热
C. 实热内炽
D. 真热假寒
E. 真寒假热

正确答案：E。真寒假热

解析：久病、重病患者面色苍白，却时而颧赤泛红如妆、游移不定，为戴阳证，是因久病阳气虚衰，阴寒内盛，阴盛格阳，虚阳浮越所致，属真寒假热之证（E对）。阴虚火旺表现为午后两颧潮红，为虚热证（A错）。湿热蕴结肝胆（B错）常导致面目一身俱黄者且黄而鲜明如橘皮（B错）。实热内炽表现为满面通红、目赤（C错）。真热假寒是指内有真热而外见某些假寒的症候。多由阳热内盛，格阴于外，阳气内闭而不能布达四末所致（D错）。